临床常用的根管消毒方法是
A. 超声消毒
B. 药物消毒
C. 微波消毒
D. 电解消毒
E. 激光消毒

正确答案：B。药物消毒

解析：本题考查根管清理与成形。对于感染根管的消毒方法以药物消毒（B对）为主。